下列关于5型磷酸二酯酶抑制剂的临床用药的说法正确的是
A. 18岁以上成人首次剂量为50mg
B. 65岁以上人群起始剂量以25mg为宜
C. 一般剂量范围为25～100mg，在性生活前1小时左右服用
D. 可用于治疗勃起功能障碍
E. 正在使用硝酸酯类药物的患者禁用

正确答案：A、B、C、D、E。18岁以上成人首次剂量为50mg；65岁以上人群起始剂量以25mg为宜；一般剂量范围为25～100mg，在性生活前1小时左右服用；可用于治疗勃起功能障碍；正在使用硝酸酯类药物的患者禁用

解析：本题考查西地那非的临床应用。西地那非用于勃起功能障碍（D对），口服，18岁以上成人首次剂量50mg（A对），在性生活前1h左右服用，可以对单次剂量进行调整，一般剂量范围为25～100mg（C对），24h内最多服用1次，单剂量100mg；65岁以上起始剂量以25mg为宜（B对）。同时，正在使用硝酸酯类药物的患者禁用西地那非（E对）。